反映居民医疗卫生服务需要的常用指标有
A. 两周患病率
B. 两周患者未就诊率
C. 两周就诊率
D. 住院率

正确答案：A。两周患病率

解析：本题考查反映居民医疗卫生服务需要的常用指标。两周患病率（A对BCD错）是反映居民医疗卫生服务需要的常用指标。两周患病率＝调查前两周内患病人（次）数/调查人数×100%。